起效缓慢，作用也弱，一般连续应用4周才能出现平缓作用的药品是
A. 布地奈德
B. 扎鲁司特
C. 沙丁胺醇
D. 羧甲司坦
E. 多索茶碱

正确答案：B。扎鲁司特

解析：本题考查扎鲁司特。扎鲁司特（B对）属于白三烯受体阻断剂，起效缓慢，作用较弱，一般连续应用4周后才见效。布地奈德（A错）属于吸入性糖皮质激素，其为控制呼吸道炎症的预防性用药，起效也比较缓慢，须连续规律的应用2日以上方可见效。沙丁胺醇（C错）属于短效β₂受体激动剂，起效较快，可迅速缓解症状。羧甲司坦（D错）为祛痰药。多索茶碱（E错）是茶碱衍生物，属于磷酸二酯酶抑制剂，可以降低第二信使cAMP和cGMP的水解，提升细胞内cAMP和cGMP的浓度，使支气管平滑肌松弛。与茶碱相比，较少引起中枢、胃肠道和心血管等不良反应，用于哮喘的治疗。